女，40岁，因宫颈癌接受化疗。近3天来常发生牙龈出血，血小板计数20×10⁹/l。遂给予血小板输注。输注后20分钟，患者突然寒战、高热、恶心，体温39.5℃，尿色正常。该患者很可能发生输血不良反应是
A. 非溶血性发热性输血反应
B. 溶血性输血反应
C. 过敏反应
D. 细菌污染反应
E. 循环超负荷

正确答案：A。非溶血性发热性输血反应

解析：患者输注血小板后20分钟，突发寒战、高热（39.1～41℃称为高热）、恶心，尿色正常，故该患者很可能发生的输血不良反应是非溶血性发热性输血反应（A对）。发热反应（P22）属最常见的早期输血并发症之一，多发生于输血开始后15分钟～2小时内，主要表现为畏寒、寒战和高热，体温可上升至39°～40°，同时可伴有头痛、恶心等症状。溶血性输血反应（B错）的典型症状为血红蛋白尿（呈酱油色或浓茶色）及溶血性黄疸。过敏反应（C错）表现为皮肤瘙痒及荨麻疹。细菌污染反应（D错）虽也可出现寒战、高热、恶心的症状，但发生率不高。循环超负荷（E错）是由输血过多或速度过快导致的，常表现为心率加快、呼吸急促、发绀或咳血性泡沫痰等症状。